我国的社会医学教学研究工作开始时间是
A. 20世纪30年代
B. 20世纪60年代
C. 20世纪初
D. 20世纪50年代
E. 20世纪80年代

正确答案：E。20世纪80年代

解析：本题考查我国的社会医学教学研究工作开始时间。20世纪80年代（E对ABCD错）初期，原卫生部在六所医学院校成立“卫生管理干部培训中心”，有力地推动了社会医学学科建设和卫生管理干部培训工作。